学龄前儿童膳食碳水化合物和脂肪提供的能量应占总能量的
A. 50%～60%和25%～30%
B. 55%～65%和20%～25%
C. 50%～65%和30%～35%
D. 50%～65%和20%～30%
E. 55%～65%和30%～35%

正确答案：C。50%～65%和30%～35%

解析：本题考查学龄前儿童膳食碳水化合物和脂肪提供的能量应占总能量的百分比。学龄前儿童膳食碳水化合物和脂肪提供的能量应占总能量的50%～65%和30%～35%（C对ABDE错）。